下述哪个核团不属于特殊内脏运动核
A. 三叉神经运动核
B. 动眼神经副核
C. 面神经核
D. 疑核
E. 副神经核

正确答案：B。动眼神经副核

解析：动眼神经副核（B对）属一般内脏运动核，支配睫状肌、瞳孔括约肌。A、C、D、E选项均属特殊内脏运动核，三叉神经运动核（A错）支配咀嚼肌；面神经核（C错）支配面肌；疑核（D错）支配咽喉肌；副神经核（E错）支配胸锁乳突肌和斜方肌。